应激时可导致机体血液重分布
A. 蓝斑-去甲肾上腺素能神经元／交感-肾上腺髓质系统兴奋
B. 下丘脑-垂体-肾上腺皮质系
C. 肾素-血管紧张素-醛固酮系统兴奋
D. 急性期反应蛋白
E. β-内啡肽

正确答案：A。蓝斑-去甲肾上腺素能神经元／交感-肾上腺髓质系统兴奋

解析：蓝斑-去甲肾上腺素能神经元／交感-肾上腺髓质系统兴奋（A对）应激时可导致机体血液重分布。